夜交藤的功效是
A. 定惊安神
B. 宁心安神
C. 解郁安神
D. 补气安神
E. 养心安神

正确答案：E。养心安神

解析：本题考查夜交藤的功效。夜交藤的功效是养心安神（E对）。夜交藤【功效】养心安神，祛风通络。琥珀【功效】安神定惊（A错），活血散瘀，利尿通淋。景天三七【功效】化瘀止血，宁心安神（B错），解毒。合欢皮【功效】解郁安神（C错），活血消肿。刺五加【功效】补气（D错）健脾，益肾强腰，养心安神，活血通络。